不符合营养性巨幼红细胞性贫血临床表现的是
A. 毛发稀疏、发黄
B. 头围增大
C. 肝、脾肿大
D. 震颤
E. 舌炎

正确答案：B。头围增大

解析：营养性巨幼红细胞性贫血以6个月至2岁多见，可出现的临床表现有毛发稀疏发黄（A对）、肝脾肿大（C对）、震颤（D对）、舌炎（E对）。而头围增大一般见于脑水肿等，营养性巨幼红细胞性贫血不会出现此表现（B错，为本题正确答案）。